女，48岁。肝炎肝硬化8年，近2个月腹围明显增大，1周来少尿，血肌酐升高，无腹痛及发热，CT提示肝硬化腹水，AFP及血常规正常，最可能的情况是
A. 肝癌
B. 肝炎活动
C. 肝肾综合征
D. 腹膜转移癌
E. 原发性胸膜炎

正确答案：C。肝肾综合征

解析：肝肾综合征（HRS）临床特征性表现为“三低一高”，即少尿或无尿、低尿钠、稀释性低血钠和氮质血症，肾脏本身无重要病理改变。掌握“肝硬化”知识点。